甲氨蝶呤的抗癌作用机制
A. 影响蛋白质的合成和功能
B. 直接破坏DNA结构
C. 干扰核酸生物合成
D. 干扰生物碱合成
E. 影响体内激素平衡

正确答案：C。干扰核酸生物合成

解析：本题考查甲氨蝶呤的作用机制。甲氨蝶呤的抗癌作用机制干扰核酸生物合成（C对）。MTX通过竞争性抑制二氢叶酸还原酶，阻断二氢叶酸还原为四氢叶酸，阻止一碳基团的转移，抑制嘌呤核苷酸和嘧啶核苷酸的合成，使脱氧胸苷酸（dTMP）合成受阻，从而使DNA和RNA的合成中断，抑制肿瘤细胞增殖。影响蛋白质的合成和功能（A错）的抗肿瘤药有紫杉醇、多西他赛、长春碱等。直接破坏DNA结构（B错）的抗肿瘤药有环磷酰胺、塞替派、顺铂、喜树碱等。干扰生物碱合成（D错）不能达到抗癌作用。影响体内激素平衡（E错）的抗肿瘤药有肾上腺皮质激素、雌激素、雄激素及其拮抗剂，如他莫昔芬、甲地孕酮等。